根管治疗术后疗效评估观察时间为
A. 半年
B. 1年
C. 2年
D. 3～5年
E. 5年以上

正确答案：C。2年

解析：本题考查根管治疗的疗效及评价标准。根管治疗术后疗效评估观察时间为2年（C对）。根管治疗术的疗效评定应符合全面性、相关性及客观性，疗效评定标准必须包括症状、临床检查和X线表现。关于疗效评估观察时间，世界卫生组织（WHO）规定的观察期为术后2年。从软组织、骨组织的愈合过程以及可能潜伏感染的再发作看，这个观察时间是科学的，1年以内（AB错）的疗效只能作为初步观察，难以定论；3年以上（DE错）的时间历时太长，随访难度大；2～3年时间的观察则比较准确。